生物标志物在环境污染与人体健康关系研究中可用于
A. 内剂量的测定
B. 暴露剂量的测定
C. 生化指标的测定
D. 靶剂量的测定
E. 以上都是

正确答案：E。以上都是

解析：本题考查生物标志物的用途。生物标志是生物体内发生的与发病机制有关联的关键事件的指示物，是机体由于接触各种环境因素所引起机体器官、细胞、亚细胞的生化、生理、免疫和遗传等任何可测定的改变。生物标志物在环境污染与人体健康关系研究中可用于内剂量的测定、暴露剂量的测定、生化指标的测定、靶剂量的测定（E对ABCD错）。